健康城市的基本特征是
A. 和谐性、整体性
B. 持续性、高效性
C. 区域性
D. 参与性、独特性
E. 以上各条都是，但都不全面

正确答案：E。以上各条都是，但都不全面

解析：本题考查健康城市的基本特征。健康城市是指不断创造和改善自然环境、社会环境，不断扩大社区资源，使人们在享受生命和充分发挥潜能方面能够相互支持的城市。其基本特征有：1.和谐性：人与自然、人与人的和谐；2.整体性：兼顾社会、经济和环境三者的整体利益，不仅重视经济发展与生态环境，更注重人类生活质量的提高；3.持续性：以可持续发展思想为指导，合理配置资源，公平地满足现代与后代在发展和环境方面的需要；4.高效性：提高一切资源的利用效率，物质和能量得到多层次分级利用，废弃物循环再生；5.区域性：健康城市作为城乡统一体，必须考虑城乡之间的相互联系和相互制约，但表现出明显的区域特征；6.参与性：强调政府承诺、部门合作和社区居民的共同参与；7.独特性：WHO虽然制定了10条标准，但每个城市要针对自身情况制定目标，因此，每个健康城市都有其特征（E错，为本题正确答案）。